口腔颌面部恶性肿瘤以下哪种肿瘤最为常见
A. 腺源性上皮癌
B. 鳞状上皮细胞癌
C. 未分化癌
D. 各类肉瘤
E. 恶性淋巴瘤

正确答案：B。鳞状上皮细胞癌

解析：本题考查最为常见的口腔颌面部恶性肿瘤。鳞状上皮细胞癌（B对）简称为鳞癌，在我国是口腔颌面外科学最常见的恶性肿瘤；恶性淋巴瘤（E错）的病例构成仅次于鳞状细胞癌；其次是腺源性上皮癌（A错）及未分化癌（C错）。各种肉瘤（D错）在口腔颌面部的恶性肿瘤中较少。